患者吐血量多，面色苍白，四肢厥冷，汗出，脉微，治疗首选方
A. 回阳救急汤
B. 生脉饮
C. 附子理中丸
D. 大补元煎
E. 独参汤

正确答案：E。独参汤

解析：题中患者吐血量多，诊断为吐血，出现面色苍白，四肢厥冷，汗出，脉微为气随血脱所致，治宜益气固脱，方用独参汤（E对）。回阳救急汤为治疗寒邪直中三阴，真阳衰微证的常用方（A错）。生脉饮益气复脉，养阴生津，治疗气阴两亏，心悸气短，脉微自汗（B错）。附子理中丸温中健脾，用于脘腹冷痛，肢冷便溏（C错）。大补元煎救本培元，大补气血，主治气血大亏，精神失守之危剧病证（D错）。